不宜制成缓释制剂的药物有
A. 半衰期＞24小时
B. 药物剂量＞1g
C. 在肠道内有特定主动吸收部位的药物
D. 药效剧烈且吸收无规律的药物
E. 易受生理因素影响的药物

正确答案：A、B、C、D、E。半衰期＞24小时；药物剂量＞1g；在肠道内有特定主动吸收部位的药物；药效剧烈且吸收无规律的药物；易受生理因素影响的药物

解析：本题考查的是不宜制成缓释、控释制剂的药物。不宜制成缓释制剂的药物有半衰期＞24小时（A对）、药物剂量＞1g（B对）、在肠道内有特定主动吸收部位的药物（C对）、药效剧烈且吸收无规律的药物（D对）与易受生理因素影响的药物（E对）。不宜制成缓释、控释制剂的药物：（1）生物半衰期（t1/2）很短（小于1小时）或很长（大于24小时）的药物。（2）单服剂量很大（大于1g）的药物。（3）药效剧烈、溶解度小、吸收无规律、吸收差或吸收易受影响的药物。（4）需在肠道中特定部位主动吸收的药物。